代谢性酸中毒在没有发展到循环衰竭程度时，首选治疗应该是
A. 使用碳酸氢钠
B. 使用乳酸钠
C. 使用枸橼酸钾
D. 使用三羟氨基甲基甲烷
E. 实施病因治疗

正确答案：E。实施病因治疗

解析：出现代谢性酸中毒时，由于机体可加快肺部通气以排出更多CO₂，又能通过肾排出H⁺、保留Na⁺及HCO₃⁻，具有一定的调节酸碱平衡的能力。因此只要实施病因治疗（E对）消除病因，再辅以补充液体、纠正缺水，较轻的（没有发展到循环衰竭程度的）代谢性酸中毒常可自行纠正，不必应用碱性药物，如碳酸氢钠（A错）、乳酸钠（B错）、枸橼酸钾（C错）和三羟甲基氨基甲烷（D错）等。对血浆HCO₃⁻低于10mmol/L的重症酸中毒病人，应立即输液和用碱剂进行治疗，常用的碱性药物是碳酸氢钠溶液。乳酸钠也可纠正重度代酸，不过作用较慢，现已少用。枸橼酸钾为碱性钾盐，主要用于补钾及碱化尿液。需注意：枸橼酸钠与枸橼酸钾作用不同，枸橼酸钠主要用于体外抗凝。三羟甲基氨基甲烷（即氨基丁三醇）为弱碱，一般用于体外实验缓冲盐酸、溶解核酸与蛋白质，临床上少用。